男性，20岁，平素健康，淋雨后突发寒颤、高热、头痛，第2天出现右侧胸痛、咳嗽、咳痰，胸片示右上肺大片实变影。最可能的诊断为
A. 胸膜增厚
B. 肺脓肿
C. 肺结核
D. 大叶性肺炎
E. 肺梗死

正确答案：D。大叶性肺炎

解析：患者为青年男性，发病前有受凉淋雨的病史（大叶性肺炎发病前常有受凉、淋雨史），之后突发寒战、高热、头痛，后出现咳嗽、咳痰，胸片示大片肺实变影（为大叶性肺炎典型的临床表现和胸片表现），考虑诊断为大叶性肺炎（D对）。胸膜增厚（A错）患者主要表现为呼吸困难，并无寒战、高热等感染症状，胸片可见胸膜增厚。肺脓肿（P58）（B错）表现为咳嗽，咳大量脓臭痰，X线可见圆形透亮区及气液平面。肺结核（P64）（C错）患者主要表现为低热、盗汗等结核中毒症状，X线胸片见病变多在肺尖或锁骨上下，密度不均，消散缓慢，可形成空洞或肺内播散。肺梗死（P99）（E错）主要表现为胸痛、呼吸困难、咯血，均与该患者病情不符。